牙板上皮残余构成的牙周上皮剩余，称为
A. 缩余釉上皮
B. 马拉瑟上皮剩余
C. 上皮根鞘
D. 上皮隔
E. 内釉上皮

正确答案：B。马拉瑟上皮剩余

解析：牙板上皮构成上皮根鞘，而在牙根发育时期，牙囊细胞突入牙根表面，剩余的上皮细胞遗留在牙周膜中，称为牙周上皮剩余，也叫马拉瑟上皮剩余。Serres上皮剩余也叫牙板上皮剩余：是指成釉器到钟状期末牙板被间充质侵入而断裂，并逐渐退化和消失，但是有时残留的牙板上皮以上皮岛或上皮团的形式存在于颌骨或牙龈中。婴儿出生不久偶见牙龈上出现针头大小白色突起，俗称马牙子，即为上皮珠。在某些情况下，残留的牙板上皮，可成为牙源性上皮性肿瘤或囊肿的起源。掌握“牙体、牙周组织的形成”知识点。